2012年，全球15～29岁年龄组第一位死亡原因是
A. 自杀
B. 肿瘤
C. 交通事故
D. 意外死亡
E. 人际暴力

正确答案：C。交通事故

解析：本题考查全球15～29岁年龄组第一位死亡原因。2012年15～29岁人群年龄组第一位死亡原因是交通事故（C对ABDE错），第二位便是自杀。